婴儿出生后4～6个月每月增长约
A. 200～300g
B. 300～400g
C. 500～600g
D. 700～800g
E. 800～1000g

正确答案：C。500～600g

解析：婴儿出生后前3个月每月增长700～800g，4～6个月每月增长500～600g，后半年（7～12个月）每月增长300～400g。掌握“体格生长常用指标”知识点。